体内维生素B₁缺乏，TPP效应是
A. ＜15%
B. ＞16%
C. ＜12%
D. ＞25%
E. ＞18%

正确答案：D。＞25%